异烟肼与利福平合用治疗结核病，应定期检查
A. 心电图
B. 肾功能
C. 肝功能
D. 血象
E. 以上均非

正确答案：C。肝功能

解析：利福平的抗菌谱较广，对结核杆菌和麻风杆菌均有作用，对繁殖期和静止期的结核杆菌都有效，是目前治疗结核病最有效的药物之一，不良反应发生率不高，主要不良反应为消化道反应、肝毒性、过敏反应和流感综合征。异烟肼可与利福平合用治疗结核病，但二者均有肝毒性，因此二者合用应定期检查肝功能（C对E错）。异烟肼可选择性作用于结核杆菌，阻止合成分枝杆菌外层分枝菌酸酶的活性，从而使细胞丧失耐酸性、疏水性和增殖力而死亡，是治疗各种结核病的首选药之一，除早期轻症肺结核或预防应用可单用外，均需要和其他一线抗结核药合用，不良反应发生率较低，除过敏反应外，主要不良反应为周围神经炎，中枢神经系统障碍，肝脏毒性，发热、皮疹（ABD错）等。